慢性阻塞性肺疾病的慢性气道炎症最主要的效应细胞是
A. 嗜酸性粒细胞
B. 树突状细胞
C. 巨噬细胞
D. 中性粒细胞
E. 淋巴细胞

正确答案：D。中性粒细胞

解析：中性粒细胞、巨噬细胞、T淋巴细胞等炎症细胞均参与了慢阻肺的发病过程，中性粒细胞（D对）是最主要的效应细胞，通过释放中性粒细胞弹性蛋白酶等多种生物活性物质引起慢性黏液高分泌状态并破坏肺实质。巨噬细胞（C错）、T淋巴细胞（E错）虽参与慢性炎症过程，但不是最主要的效应细胞。嗜酸性粒细胞（A错）、淋巴细胞（E错）在呼吸道疾病中与支气管哮喘有关。树突状细胞（B错）与肿瘤的发生发展有密切联系，不参与慢阻肺的支气管炎症反应。